代谢性酸中毒合并代谢性碱中毒的特点是
A. 导致血浆HCO₃⁻降低和升高的原因同时存在
B. HCO₃⁻在正常范围
C. pH在正常范围
D. PaCO₂常在正常范围
E. 以上都是

正确答案：E。以上都是

解析：发生代谢性酸中毒合并代谢性碱中毒时，导致血浆HCO₃⁻升高和降低的原因同时存在（A对），彼此相互抵消，所以导致HCO₃⁻在正常范围（B对），pH在正常范围（C对），PaCO ₂常在正常范围（D对，故E为本题正确答案）。